肾母细胞瘤的临床特点是
A. 血尿
B. 腰痛
C. 腹部包块
D. 高血压
E. 发热

正确答案：C。腹部包块

解析：肾母细胞瘤是小儿最常见的恶性肿瘤，多在5岁前发病，最主要的临床表现为腹部肿块（C对），多位于上腹一侧季肋部，表面光滑，中等硬度，可随呼吸活动。血尿（A错）、腰痛（B错）为肾肿瘤的一般表现；发热（E错）、高血压（D错）、红细胞增多症等为副瘤综合征的表现，可见于多种恶性肿瘤。